下列对于紫杉醇的叙述，不正确的是
A. 可溶于甲醇、丙酮、三氯甲烷等溶剂
B. 碱性条件下分解，对酸相对较稳定
C. 紫杉醇为碱性较强的化合物
D. 在植物体内可以以游离态存在，也可与糖成苷存在
E. 具有还原性

正确答案：C。紫杉醇为碱性较强的化合物